声波从外耳道传至耳内，其传导的途径是
A. 鼓膜→听骨链→蜗窗
B. 鼓膜→听骨链→前庭窗
C. 鼓膜→中耳→耳蜗→内耳
D. 鼓膜→外耳道→听骨链→内耳
E. 外

正确答案：B。鼓膜→听骨链→前庭窗

解析：正常情况下声音以空气传导为主。声波引起鼓膜震动，使听小骨运动，放大声音，经镫骨底到前庭窗，再引起前庭阶的外淋巴波动，传入内耳（B对）。